磨牙的继发性牙本质主要沉积在
A. 髓室顶
B. 髓室底
C. 髓室高度
D. 根管口
E. 髓角

正确答案：B。髓室底

解析：髓室增龄变化的继发性牙本质沉积方式因牙位而不同，上颌前牙继发性牙本质主要沉积在髓室舌侧壁，其次为髓室顶。磨牙主要沉积在髓室底，其次为髓室顶和侧壁。掌握“髓腔各部分名称、增龄性变化及临床意义”知识点。